下列除哪项外，均是脉象有胃气的特点
A. 不浮不沉
B. 不快不慢
C. 柔和有力
D. 从容和缓
E. 节律一致

正确答案：C。柔和有力

解析：脉律整齐，柔和有力是为脉象有神气的特点，而非脉象有胃气的特点（C对）。脉象有胃气的特点：不浮不沉，不疾不徐，来去从容，节律一致，故A、B、D、E四个选项是脉有胃气的特点（ABDE错）。